益母草和薄荷药材性状的主要区别是
A. 茎的形状
B. 叶片的形状
C. 叶序类型
D. 花序类型
E. 果实类型

正确答案：B。叶片的形状